导致阑尾穿孔最主要的因素是
A. 阑尾腔阻塞
B. 阑尾壁受粪石压迫缺血
C. 细菌毒力
D. 淋巴管阻塞
E. 免疫力低

正确答案：A。阑尾腔阻塞

解析：阑尾腔阻塞是急性阑尾炎最常见的原因。阑尾管腔细，阻塞后阑尾黏膜仍继续分泌黏液，使腔内压力不断上升，血运发生障碍，炎症加重，最终导致阑尾穿孔、坏疽。因此，导致阑尾穿孔最主要的因素是阑尾腔阻塞（A对）。而淋巴滤泡增生、粪石是引起阑尾腔阻塞的常见原因（分别约占60%、35%）（B错）。细菌（C错）、淋巴管阻塞（D错）、免疫力低（E错）等因素可引起阑尾炎，但不是导致的阑尾穿孔的主要因素。